骨折的特有体征是
A. 局部皮下瘀斑
B. 功能障碍
C. 反常活动
D. 轴向叩击痛
E. 局部压痛

正确答案：C。反常活动

解析：骨折的特有体征有三个：畸形、反常活动（C对）、骨擦音或骨擦感。局部皮下瘀斑（A错）、功能障碍（B错）、局部压痛（E错）均为骨折的一般表现，不具有特异性，非骨折特有。轴向叩痛（P619）（D错）为评价骨折临床愈合的检查，不属于骨折的特有体征。